男性，21岁，下水道工人，因发热，全身酸痛，乏力5天于8月2日入院，查体：结膜充血，皮肤有出血疹，腹股沟淋巴结蚕豆大，伴有压痛，腓肠肌压痛（+），血象WBC13.2×10⁹/L，N80%，L20%，钩端螺旋体凝集溶解试验阳性（1：400），应首选下列何种药物
A. 青霉素每次40万U肌内注射，每天120万U~160万U
B. 青霉素每次80万U肌内注射，每天240万U~320万U
C. 青霉素每次80万U加链霉素0.5g肌注，每天2次
D. 复方新诺明1g，每天分2次口服
E. 螺旋霉素0.2g，每天4次日服

正确答案：A。青霉素每次40万U肌内注射，每天120万U~160万U

解析：青年患者，下水道工人（钩端螺旋体易感人群），发热，乏力，全身酸痛（钩端螺旋体病早期的主要临床表现）来院就诊，查体：结膜充血，皮肤有出血疹，腹股沟淋巴结肿大并伴有压痛，腓肠肌压痛（+）（钩端螺旋体病早期的特征性体征），血象：WBC13.2×10⁹/L（正常值为4～10×10⁹/L，白细胞增多），N80%（正常值为50%～70%，中性粒细胞增多），L20%（正常值为20%～40%），钩端螺旋体凝集溶解试验阳性（1：400）（确诊指标），根据该患者的临床症状、体征及实验室检查，最可能的诊断为钩端螺旋体病，应首选青霉素治疗，常用剂量为40万U/次，每6-8小时肌内注射1次，即每天120万U～160万U（A对）。